双端固定桥固位不良的原因有
A. 两端基牙牙周膜面积不同
B. 两端基牙数目不同
C. 基牙轴面聚合度过小
D. 桥体强度不足
E. 两端固位体的固位力相差悬殊

正确答案：E。两端固位体的固位力相差悬殊

解析：基牙两端的固位体固位力应基本相等：若两端固位体的固位力相差悬殊时，固位力较弱的一端固位体与基牙之间易松动，而固位力强的一端固位体又暂时无松动，使固定桥不会发生脱落，但松动端的基牙易产生龋病，甚至引起牙髓炎。因此若一端固位力不足时，应设法提高固位力，必要时增加基牙数，以便与另一端固位体的固位力相均衡。掌握“固定桥的组成和分类”知识点。